“贮痰之器”是指
A. 肾
B. 脾
C. 胃
D. 肝
E. 肺

正确答案：E。肺

解析：本题考查脾肺在水液代谢过程中的作用，属于理解记忆内容。人体的水液，由脾气上输于肺，通过肺的宣发肃降而布散周身及下输肾或膀胱。肺脾两脏协调配合，相互为用，是保证津液正常输布与排泄的重要环节。若脾失健运，水液不化，聚湿生痰，为饮为肿，影响及肺则失其宣降而痰嗽喘咳。是病其标在肺，而其本在脾，故有“脾为生痰之源，肺为贮痰之器”（E对）之说。